如果要评价某药物预防某病的流行病学效果，应采用哪种研究方法
A. 实验流行病学
B. 现况研究
C. 队列研究
D. 临床研究
E. 专题调查

正确答案：A。实验流行病学